抽取的血液标本，如未与空气隔绝，下列哪项指标的测定结果将受影响？
A. SB
B. BB
C. AG
D. BE
E. AB

正确答案：E。AB

解析：AB（E对）需要在隔绝空气的条件下测定，不然会受到空气中CO₂的影响。